慢性龈缘炎病因中的始动因素是
A. 牙石
B. 不良修复体
C. 食物嵌塞
D. 菌斑
E. 口呼吸

正确答案：D。菌斑

解析：在龈缘附近的牙面上长期积聚的牙菌斑是引起慢性龈缘炎的始动因子。其他如牙石、食物嵌塞、不良修复体等均可促使菌斑的积聚，引发或加重牙龈的炎症。掌握“牙周炎病因学”知识点。